“入芝兰之室，久闻而不知其香”说明的是
A. 感觉过敏
B. 感觉适应
C. 感觉相互作用
D. 感觉减退
E. 感受性补偿

正确答案：B。感觉适应